引起“肠源性青紫症”的原因是
A. 食用较多含硝酸盐高的蔬菜
B. 食用大量发芽的马铃薯
C. 食入未炒熟的四季豆
D. 食入有毒蘑菇
E. 食入青皮红肉鱼类

正确答案：A。食用较多含硝酸盐高的蔬菜